肿瘤细胞排列成大小不等的上皮团，团块中心变性坏死，管状和筛孔状结构较少，此为腺样囊性癌的哪种分型
A. 腺性型
B. 包膜型
C. 管状型
D. 黏液型
E. 实性型

正确答案：E。实性型

解析：本题考查腺样囊性癌的组织类型。肿瘤细胞排列成大小不等的上皮团，团块中心变性坏死，管状和筛孔状结构较少，此为腺样囊性癌的哪种分实性型（E对）。实性型腺样囊性癌的细胞排列成大小不等的上皮团，大的团块中心组织可变性坏死，管状和筛孔状结构较少。实性型通常比其他类型容易复发和早期转移，预后差。